欲比较三种药物降低乙肝病人血液中GPT量的效果。已知病情和年龄对治疗效果有影响，将12名男性乙肝病患者按病情和年龄相近配成4组，每组3人；再把每一配伍组的3人随机分配到3个治疗组，每名患者测得治疗后的GPT下降量。首选的统计检验方法是
A. 多个样本率比较的χ²检验
B. 4×3表χ²检验
C. 完全随机设计资料的方差分析
D. 配伍组设计资料的方差分析
E. 配伍设计资料的秩和检验

正确答案：D。配伍组设计资料的方差分析